休克期（微循环淤血性缺氧期）微循环的灌流特点是
A. 少灌少流，灌少于流
B. 少灌多流，灌少于流
C. 多灌少流，灌多于流
D. 多灌多流，灌多于流
E. 多灌多流，灌少于流

正确答案：C。多灌少流，灌多于流

解析：多灌少流，灌多于流（C对ABDE错），组织呈淤血性缺氧状态是休克期（微循环淤血性缺氧期）微循环的灌流特点。